首见“疟疾”病名的医籍是
A. 《内经》
B. 《金匮要略》
C. 《神农本草经》
D. 《诸病源候论》
E. 《瘟疫论》

正确答案：A。《内经》

解析：《内经》首载疟疾之名，并对其病因、证候、治法作了详细讨论（A对）。《金匮要略·疟病脉证并治》阐述了瘅疟、温疟、牝疟等各种不同类型疟疾的辨证论治（B错）。《神农本草经》明确记载了常山、蜀漆有治疟的功效（C错）。《诸病源候论》提出间日疟和劳疟病名（D错）。《瘟疫论》中制定达原饮，用槟榔、厚朴、草果等使邪气溃散，速离募原（E错）。